艾滋病的口腔常见病损不包括
A. 口腔毛状白斑
B. 龋齿形成
C. 卡波西肉瘤
D. 非霍奇金淋巴瘤
E. 口腔念珠球菌病

正确答案：B。龋齿形成

解析：艾滋病的口腔常见病损：包括：①口腔毛状白斑；②口腔念珠球菌病；③卡波西肉瘤；④非霍奇金淋巴瘤。掌握“口腔医疗保健中的感染”知识点。